女，23岁，因原发性甲状腺功能亢进症在气管内插管全麻下行甲状腺双侧次全切术，术后清醒拔出气管插管后患者出现呼吸困难，伴有失音，无手足麻木。查体：T37.3℃，P92次/分，R28次/分，BP130/70mmHg，面红无发绀，颈部不肿，引流管通畅，有少许血液流出。引起该患者呼吸困难最可能的原因是
A. 喉上神经损伤
B. 伤口出血
C. 甲亢危象
D. 双侧喉返神经损伤
E. 甲状旁腺损伤

正确答案：D。双侧喉返神经损伤

解析：喉返神经分为前、后两支，前支支配声带内收肌，后支支配声带外展肌。前支损伤引起声带内收肌麻痹而使声带外展；后支损伤引起声带外展肌瘫痪而使声带内收。喉返神经损伤可有不同的临床表现：一侧喉返神经损伤若为后支损伤，可无明显临床表现，若为前支或全支损伤，大多引起声音嘶哑；双侧喉返神经损伤，可引起严重的呼吸困难，甚至窒息死亡。该患者作甲状腺手术后，拔管后立即出现呼吸困难，而手术切口无明显异常，考虑双侧喉返神经损伤（D对）。喉上神经损伤（A错）若为内支损伤，常导致饮水呛咳；若为外支损伤，则导致音调降低。伤口出血（B错）可引起呼吸困难，但大多发生在手术后24～48小时后，多存在颈部肿胀、伤口渗血、引流不畅，与患者临床表现不符。甲亢危象（C错）多表现为高热、脉快，同时合并神经、循环及消化系统严重功能紊乱，与该患者临床表现不符。甲状旁腺损伤（E错）导致PTH分泌减少，血钙降低，严重者可发生喉与膈肌痉挛，引起呼吸困难甚至窒息，但多伴有手足麻木或抽搐等低血钙表现。